营养眼球外肌的血管发自
A. 视网膜中央动脉
B. 睫后短动脉
C. 眼动脉
D. 睫后长动脉
E. 睫前动脉

正确答案：C。眼动脉

解析：营养眼球外肌的血管发自眼动脉（C对）。